慢性苯中毒会累及的系统是
A. 血液系统
B. 消化系统
C. 中枢神经系统
D. 泌尿系统
E. 呼吸系统

正确答案：A。血液系统

解析：慢性苯中毒时苯代谢产物（邻苯二酚、氢醌和苯醌）抑制骨髓基质生成造血干细胞，干扰细胞增殖和分化的调节因子，阻断造血干细胞分化过程而诱发白血病（A对）。急性苯中毒后会损害细胞膜结构，影响细胞膜蛋白功能，干扰细胞膜的脂质和磷脂代谢，抑制细胞膜功能，导致中枢神经麻醉（C错）。